一般情况下法定传染病报告人不包括
A. 疾病预防控制机构的医师
B. 出入境检验检疫工作人员
C. 体检中心的医师
D. 医疗机构的就诊者
E. 血站的护士

正确答案：D。医疗机构的就诊者

解析：法定传染病报告人为各级各类医疗机构、疾病预防控制机构、采供血机构执行职务的人员和乡村医生、个体开业医生均为责任疫情报告人。因此疾病预防控制机构的医师（A对）、出入境检验检疫工作人员（B对）、体检中心的医师（C对）、血站的护士（E对）均为传染病报告人。